男，30岁。B超发现右肾盂结石，大小2cm×1.5cm，合并轻度肾积水。首选的治疗方案是
A. 体外冲击波碎石术
B. 经皮肾镜碎石
C. 多饮水+药物治疗
D. 肾盂切开取石
E. 服用中药排石

正确答案：A。体外冲击波碎石术

解析：青年男性患者，右肾盂2cm×1.5cm结石，肾积水轻度，提示患者远端尿路尚未梗阻，因此应首选体外冲击波碎石术（A对）。经皮肾镜碎石（B错）主要适用于鹿角结石、≥2cm的肾结石、有症状的肾盏或憩室内结石等。多饮水+药物治疗（C错）、服用中药排石（E错）适用于结石小于0.6cm、表面光滑、结石以下尿路无梗阻的病人。肾盂切开取石（D错）主要用于肾盂输尿管处梗阻并肾盂结石的患者，可在取石的同时解除梗阻。